附子的化学成分主要为
A. 间苯三酚衍生物
B. 三萜皂苷类
C. 蒽醌类
D. 生物碱类
E. 香豆素类

正确答案：D。生物碱类

解析：本题考查的是附子的主要成分。附子的化学成分主要为生物碱类（D对）。附子【成分】根含总生物碱，其中主要为剧毒的双酯类生物碱，附子因系加工品，原来生品中所含毒性很强的双酯类生物碱，在加工炮制的过程中易水解，失去一分子醋酸，生成毒性较小的单酯类生物碱苯甲酰乌头原碱、苯甲酰新乌头原碱和苯甲酰次乌头原碱。绵马贯众【成分】根茎含间苯三酚类化合物（A错），有绵马酸类、黄绵马酸类、白绵马素类、去甲绵马素类、绵马酚、绵马次酸、粗蕨素等。人参【成分】主含皂苷类化合物，根含总皂苷约4%，须根中含量较主根高。主要皂苷类成分30余种，分别称为人参皂苷R₀、Ra、Rb₁、Rb₂、Rbg、Re、Rd、Re、Rf等，以及丙二酰基人参皂苷Rb₁、Rb₂、Re、Rd。均为三萜皂苷（B错）。大黄【成分】游离蒽醌衍生物（C错）有大黄酸、大黄素、大黄酚、芦荟大黄素、太黄素甲醚等，为大黄的抗菌成分。补骨脂【成分】含挥发油、香豆素（E错）、黄酮类、单萜酚、脂类化合物、树脂及豆甾醇等。香豆素衍生物主要为补骨脂素、异补骨脂素、补骨脂定、异补骨脂定、双羟异补骨脂定，以及苯并呋喃香豆素。